现代临终关怀事业的创立者是
A. 南丁格尔
B. 桑德斯
C. 希波克拉底
D. 白求恩
E. 恩格尔

正确答案：B。桑德斯